添加适宜适量电解质使混悬液中的微粒形成疏松聚集体的过程，称为
A. 胶体溶液型液体药剂
B. 破裂
C. 起昙
D. 溶胶剂
E. 絮凝

正确答案：E。絮凝